患者王某，常自汗出，夜卧尤甚，心悸惊悌，气短烦倦，舌淡红，脉细弱治宜选用
A. 玉屏风散
B. 牡蛎散
C. 归脾汤
D. 补中益气汤
E. 桂枝汤

正确答案：B。牡蛎散

解析：“常自汗出，夜卧尤甚”提示心阴不足，心阳不潜；“心悸惊悌，气短烦倦”心之气阴耗伤，心神失养；“舌淡红，脉细弱”均为气阴两虚之象，证当属自汗、盗汗证，治以敛阴止汗，益气固表，方选牡蛎散（B对）。牡蛎散方中煅牡蛎咸涩微寒，敛阴潜阳，固涩止汗，为君药。生黄芪味甘微温，益气实卫，固表止汗，为臣药。君臣相配，是为益气固表、敛阴潜阳的常用组合。麻黄根甘平，功专收敛止汗，为佐药。小麦甘凉，专入心经，养气阴，退虚热，为佐使药。玉屏风散功用为益气固表止汗，主治表虚自汗证（A错）。归脾汤功用为益气补血，健脾养心，主治心脾气血两虚证；脾不统血证（C错）。补中益气汤功用为补中益气，升阳举陷，主治脾胃气虚证（D错）。桂枝汤功用为解肌发表，调和营卫，主治外感风寒表虚证（E错）。